保管中最易受潮变质的常用药品是
A. 硝苯地平片
B. 多酶片
C. 维拉帕米片
D. 甲氧氯普胺片
E. 艾司唑仑片

正确答案：B。多酶片

解析：本题考查药品的贮存。多酶片（B对）保管中最易受潮变质，保存时应注意控制湿度。维拉帕米片（C错）是易受温度影响，需要在阴凉处贮存。硝苯地平片（A错）需遮光，密封保存。甲氧氯普胺片（D错）需密封保存。艾司唑仑片（E错）需遮光，密封保存。